糖皮质激素对血液成分的影响是
A. 血红蛋白含量降低
B. 血小板减小
C. 嗜酸粒细胞增加
D. 中性粒细胞减少
E. 淋巴细胞减少

正确答案：E。淋巴细胞减少

解析：本题考查糖皮质激素的影响。糖皮质激素对血液成分的影响：糖皮质激素使红细胞和血红蛋白含量增加（A错），大剂量可使血小板增多（B错）并提高纤维蛋白原浓度，缩短凝血时间。此外，可使血液中嗜酸细胞及淋巴细胞减少（E对C错）。